坏死组织经腐败作用后常可发生
A. 脓肿
B. 空洞
C. 梗死
D. 坏疽
E. 栓塞

正确答案：D。坏疽

解析：坏死组织经腐败菌作用后常可发生坏疽（D对）。空洞（P21）（B错）是指坏死物液化后，经自然管道排出体外后所残留的空腔。梗死（P44）（C错）是指器官或局部组织由于缺血、栓塞导致缺氧而发生的坏死。栓塞（P54）（E错）是指血液循环中，不溶于血液的异常物质随血流运行而阻塞血管腔的现象。